某男，50岁。冠心病心绞痛病史5年，查血清肌酐、尿素氮均增高。近因劳累复发，心前区疼痛加重1周，神疲乏力，气短懒言，心悸自汗；舌体胖大有齿痕，舌质淡暗，舌苔薄白，脉弱而涩。根据辨证结果，宜选用的基础方剂是
A. 血府逐瘀汤
B. 苏合香丸
C. 补阳还五汤
D. 瓜蒌薤白桂枝汤
E. 桃仁红花煎

正确答案：C。补阳还五汤

解析：本题考查的是胸痹的辨证论治。冠心病心绞痛病史5年，查血清肌酐、尿素氮均增高。近因劳累复发，心前区疼痛加重1周，神疲乏力，气短懒言，心悸自汗；舌体胖大有齿痕，舌质淡暗，舌苔薄白，脉弱而涩。根据辨证结果，宜选用的基础方剂是补阳还五汤（C对）。胸痹是指以胸部闷痛，甚则胸痛彻背，短气、喘息不得卧为主症的疾病，轻者仅感胸闷如窒，呼吸欠畅，重者则有胸痛，严重者心痛彻背，背痛彻心。西医学的冠心病（心绞痛或心肌梗死）、其他原因引起的心绞痛（如主动脉瓣狭窄、梗阻性肥厚型心肌病）、心包炎以及肺源性心脏病等以上述表现为主者，可参考此内容辨证论治。（一）气虚血瘀证：【症状】胸痛隐隐，遇劳则发，神疲乏力，气短懒言，心悸自汗。舌胖有齿痕，色淡暗，苔薄白，脉弱而涩，或结、代。【方剂应用】基础方剂为补阳还五汤（当归、川芎、黄芪、桃仁、红花、地龙、赤芍）加减。（二）气滞血瘀证：【症状】心胸疼痛，如刺如绞，痛有定处，入夜为甚，重者心痛彻背，背痛彻心，或痛引肩背，伴有胸闷，日久不愈，可因暴怒、劳累而加重。舌质紫暗，有瘀斑，苔薄，脉弦细。【方剂应用】基础方剂为血府逐瘀汤（A错）（当归、生地、桃仁、红花、枳壳、赤芍、柴胡、川芎、桔梗、牛膝、甘草）加减。（三）痰浊痹阻证：【症状】胸闷重而心痛微，痰多气短，肢体沉重，形体肥胖，遇阴雨天而易发作或加重，伴有倦怠乏力，纳呆便溏，咳吐痰涎。舌体胖大且边有齿痕，苔浊腻或白滑，脉滑。【方剂应用】基础方剂为瓜蒌薤白半夏汤（瓜蒌、薤白、半夏、白酒）合涤痰汤（制半夏、制南星、陈皮、枳实、茯苓、人参、石菖蒲、竹茹、甘草、生姜）加减。（四）寒凝心脉证：【症状】猝然心痛如绞，心痛彻背，喘不得卧，多因气候骤冷或骤感风寒而发病或加重，伴形寒，甚则手足不温，冷汗自出，胸闷气短，心悸，面色苍白。舌质紫暗，或有瘀斑瘀点，苔薄，脉沉紧或沉细。【方剂应用】基础方剂为枳实薤白桂枝汤（枳实、厚朴、薤白、桂枝、瓜蒌实）合当归四逆汤（当归、桂枝、芍药、细辛、通草、炙甘草、大枣）加减。【中成药应用】常用中成药有宽胸气雾剂、苏合香丸（B错）、冠心苏合滴丸、神香苏合丸（庆余救心丸）。（五）气阴两虚证：【症状】胸闷隐痛，时作时止，心悸气短，动则益甚，伴倦怠懒言，易汗出，头晕，失眠多梦。舌红或淡红，舌体胖且边有齿痕，苔薄白或少，脉细缓或结代。【方剂应用】基础方剂为生脉散（人参、麦冬、五味子）合人参养荣汤（人参、熟地黄、当归、白芍、白术、茯苓、黄芪、陈皮、五味子、桂心、远志、炙甘草）加减。桃仁红花煎（E错）为心悸瘀阻心脉证的方剂应用。心悸瘀阻心脉证：【症状】心悸不安，胸闷不舒，心痛时作，痛如针刺，唇甲青紫。舌质紫暗或有瘀斑，脉涩或结或代。【方剂应用】基础方剂为桃仁红花煎（丹参、赤芍、桃仁、红花、乳香、香附、延胡索、青皮、当归、川芎、生地）合桂枝甘草龙骨牡蛎汤（桂枝、甘草、龙骨、牡蛎）加减。方剂应用为瓜蒌薤白桂枝汤（D错）的病证，2022年考试指南未明确说明。